正确描述上颌神经的是
A. 通过眶上裂
B. 支配面部表情肌
C. 支配舌后1/3味觉
D. 支配咀嚼肌
E. 其细胞体位于三叉神经节内

正确答案：E。其细胞体位于三叉神经节内

解析：三叉神经包含一般躯体感觉和特殊内脏运动两种纤维，其中躯体感觉神经纤维的胞体位于三叉神经节内，上颌神经（三叉神经分支）含一般躯体感觉纤维，因而上颌神经的细胞体位于三叉神经节内（E对）。上颌神经入眶的位置为眶下裂（A错）。支配面部表情肌（B错）的神经是面神经。支配舌后1/3味觉（C错）的神经是舌咽神经。支配咀嚼肌（D错）的神经是下颌神经。